感冒初，出现卡他症状，如鼻黏膜充血、打喷嚏、流眼泪、流鼻涕，宜选服
A. 含伪麻黄碱及氯苯那敏制剂
B. 含氢溴酸右美沙芬制剂
C. 含中枢兴奋剂咖啡因制剂
D. 含非甾体抗炎药制剂
E. 含离子通道阻滞剂制剂

正确答案：A。含伪麻黄碱及氯苯那敏制剂

解析：本题考查感冒用药。感冒初，出现卡他症状，如鼻黏膜充血、打喷嚏、流眼泪、流鼻涕，宜选服含伪麻黄碱及氯苯那敏制剂（A对）。感冒初始阶段，可出现卡他症状，如鼻腔黏膜血管充血、喷嚏、流泪、流涕、咽痛、声音嘶哑等症状，可选服含有盐酸伪麻黄碱或氯苯那敏的制剂，如美扑伪麻、酚麻美敏胶囊、双扑伪麻、氨酚伪麻、伪麻那敏、氨酚曲麻等制剂。含氢溴酸右美沙芬制剂（B错）用于感冒同时伴有咳嗽者。含中枢兴奋剂咖啡因制剂（C错）能增强对乙酰氨基酚的解热镇痛效果，并能减轻其他药物所致的嗜睡、头晕等中枢抑制作用。含非甾体抗炎药制剂（D错）、含离子通道阻滞剂制剂（E错）适用于感冒后有微热或流感后伴有高热的患者。